脱敏治疗的最佳适应证为
A. 精神分裂症
B. 恐怖症
C. 躁狂症
D. 神经衰弱
E. 强迫症

正确答案：B。恐怖症

解析：系统脱敏疗法是行为疗法的一种，它的基本思想是：治疗师帮助患者建立与不良行为反应相对抗的松弛条件反射，然后在接触引起这种行为的条件刺激中，将习得的放松状态用于抑制焦虑反应，使不良行为逐渐消退（脱敏），最终使不良行为得到矫正。系统脱敏主要用于治疗恐怖症（B对）。精神分裂症（A错）、躁狂症（C错）、神经衰弱（D错）、强迫症（E错）均不是脱敏治疗的适应症。